评价医疗行为是否有利于人类生存和改善，是否有利于人类健康符合
A. 行为标准
B. 科学标准
C. 经济标准
D. 疗效标准
E. 社会标准

正确答案：E。社会标准

解析：医学道德评价的标准主要有疗效标准、社会标准和科学标准。社会标准即医疗行为是否有利于人类生存环境的保护和改善（E对）。